传染期的意义
A. 确定消毒时间的长短
B. 确定病人的隔离期限
C. 推断受感染的时间
D. 作为应急接种的参考
E. 推断致病因子

正确答案：B。确定病人的隔离期限

解析：本题考查传染期的意义。传染期是指病人排出病原体的整个时期。传染期的长短可影响疾病的流行特征。传染期是决定传染病病人隔离期限（B对ACDE错）的重要依据。